哪个是错的
A. 睫状肌收缩时,睫状小带放松
B. 中膜可分为前部的虹膜,中部的睫状体和后部的葡萄膜
C. 虹膜和角膜相交处形成前房角
D. 看近距离物体时瞳孔缩小
E. 睫状体又可分为后部的睫状环和前部的睫状突

正确答案：B。中膜可分为前部的虹膜,中部的睫状体和后部的葡萄膜

解析：睫状小带连结睫状体和晶状体，且睫状体肌纤维呈环形分布，当睫状体肌收缩时，睫状小带放松（A对），晶状体凸度变大。眼球从外向内依次分为眼球纤维膜、血管膜和视网膜3层，其血管膜即为眼球中膜。中膜又可分为前部的虹膜, 中部的睫状体和后部的脉络膜，而非葡萄膜（B错，为本题正确答案）。虹膜和角膜相交处形成虹膜角膜角，又称前房角（C对）。在强光下或看近物时，瞳孔缩小（D对）以减小进光量。睫状体可分为后部的睫状环和前部的睫状突（E对）。